铸造3/4冠的固位力，主要依靠
A. 邻面片切彼此平行
B. 切缘沟的位置
C. 舌面与牙长轴平行
D. 邻轴沟的长度和深度
E. 邻轴沟彼此平行

正确答案：D。邻轴沟的长度和深度

解析：本题考查铸造3/4冠的固位力。3/4冠的固位主要依靠邻轴沟沟固位形，沟固位力量的大小，首先取决于沟的深度，一般为1mm，过深则易损伤牙髓；其次，沟越长，固位越好，应尽量争取在不刺激牙髓的前提下，加大长度，故铸造3/4冠的固位力主要依靠邻轴沟的长度和深度（D对）。邻面片切是能够抵抗邻向脱位的辅助固位形，其彼此平行（A错）的主要目的是为了方便铸造3/4冠的就位，而不是为3/4冠提供固位力。切缘沟位置（B错）的选择主要考虑的是对美观的影响，置于切缘的舌侧则更为美观。舌面与牙长轴平行（C错）以及邻轴沟彼此平行（E错），都是为了利于铸造3/4冠的就位，并不是铸造3/4全冠固位力的主要依靠。